煅石膏长于
A. 清热泻火
B. 滋阴生津
C. 润肠通便
D. 收敛生肌
E. 消肿止痛

正确答案：D。收敛生肌

解析：本题考查的是石膏的功效。煅石膏长于收敛生肌（D对）。石膏：【功效】生用：清热泻火（A错），除烦止渴；煅用：收湿敛疮，生肌止血。生地：【功效】清热凉血，养阴生津（B错），润肠。决明子：【功效】清肝明目，润肠通便（C错）。栀子：【功效】泻火除烦，清热利尿，凉血解毒，消肿止痛（E错）。